以下关于结核分枝杆菌说法错误的是
A. 结核分枝杆菌的典型形态为直或微弯曲的细长杆菌
B. 结核分枝杆菌用萋-尼氏染色法抗酸性弱
C. 结核分枝杆菌为需氧菌
D. 结核分枝杆菌生长缓慢，最适生长温度为37℃
E. 结核分枝杆菌在外界环境因素的影响下容易发生毒力变异

正确答案：B。结核分枝杆菌用萋-尼氏染色法抗酸性弱